导致脂肪肝的主要原因是
A. 肝内脂肪合成过多
B. 肝内脂肪分解过多
C. 肝内脂肪运出障碍
D. 食入脂肪过多
E. 食入糖类过多

正确答案：C。肝内脂肪运出障碍

解析：如果因营养不良、中毒、缺乏胆碱等原因致使肝细胞合成的甘油三酯聚集在肝细胞液中，就会逐步形成脂肪肝。此外，肥胖、活动过少时，能量消耗减少，糖转变成脂肪增多，以及糖代谢障碍导致脂肪动员增强，进入肝内的脂肪酸增多也是引起脂肪肝的原因。掌握“脂质功能，消化吸收，及合成”知识点。